某市卫生部门在该市所有大、中、小学校开展健康监测工作，对于每个学校监测人数的确定，以下说法正确的是
A. 每性别一年龄组监测人数不应少于300人
B. 每性别一年级组监测人数不应少于300人
C. 每性别组监测人数不应少于300人
D. 每年龄组监测人数不应少于300人
E. 每年级监测人数不应少于300人

正确答案：A。每性别一年龄组监测人数不应少于300人